下列哪项不是地图舌的临床表现特点
A. 多见于成年人
B. 好发于舌背、舌尖和舌缘部
C. 舌丝状乳头萎缩
D. 有昼夜间“游走”变位特征
E. 一般无疼痛等不良感觉

正确答案：A。多见于成年人

解析：本题考查地图舌的临床表现。地图舌又称地图样舌，是一种浅表性非感染性的舌部炎症。因其表现类似地图标志的蜿蜒国界，故名地图舌。儿童多发尤以6个月～3岁多见，而不是多见于成年人（A错，为本题的正确答案），也可发生于中青年，成人中女性多于男性。好发于舌背、舌尖和舌缘部（B对）。舌丝状乳头萎缩（C对）微凹、黏膜充血发红、表面呈光滑的剥脱样红斑。有昼夜间“游走”变位特征（D对），因病损的萎缩与修复同时发生的特点，使病变位置及形态不断变化，似在舌背移动“游走”，病损多在人字沟前，可昼夜发生明显的位置移动。一般无疼痛等不良感觉（E对），但合并真菌、细菌感染或伴沟纹舌继发感染时，若接触刺激性食物会出现烧灼样疼痛或钝痛。